特发性血小板减少性紫癜做骨髓穿刺是为了
A. 证明有血小板减少
B. 了解骨髓增生程度有无低下
C. 了解有无合并缺铁性贫血
D. 证明有血小板抗体存在
E. 了解巨核细胞数量及有无成熟障碍

正确答案：E。了解巨核细胞数量及有无成熟障碍

解析：特发性血小板减少性紫癜的诊断要点之一就是进行骨髓象的检查检测到巨核细胞数量正常或者增多；故需要进行骨髓穿刺。掌握“特发性血小板减少性紫癜（ITP）”知识点。